患者，女，27岁，已婚。产后小腹疼痛，拒按，恶露少、色黯、有块，行而不畅，胸胁胀痛，舌暗苔白滑，脉弦涩。其诊断是
A. 产后恶露过少血瘀证
B. 产后血晕血瘀证
C. 产后腹痛血瘀证
D. 产后胁痛血瘀证
E. 以上均非

正确答案：C。产后腹痛血瘀证

解析：患者产后小腹疼痛，拒按，恶露少，色黯，有块，是因为血行不畅，阻滞冲任，瘀血停留于子宫，胞脉不通，恶露当下不下；胸胁胀痛，舌黯苔白滑，脉弦涩是气滞血瘀之象，故诊断为产后腹痛血瘀（C对E错）。产后恶露过少血瘀证多表现为产后恶露量少，色紫黯，有血块，小腹多为胀痛，血块排除后胀痛减轻，舌紫暗有瘀斑或瘀点，脉沉弦或沉涩（A错）。产后血晕血瘀证多表现为产后恶露不下或量少，少腹阵痛拒按，突然头晕眼花，不能起坐，甚则心下急满，气粗喘促，神昏口噤，不省人事，两手握拳，牙关紧闭，面色青紫，唇舌紫黯，脉涩（B错）。产后胁痛血瘀证多表现为胁肋部一侧或两侧刺痛，入夜疼痛加剧，并伴有舌紫暗有瘀点或瘀斑（D错）。